治疗肾虚腰痛而无明显阴阳偏盛者，可选用的方剂是
A. 杜仲丸
B. 青娥丸
C. 补髓丹
D. 虎潜丸
E. 补血荣筋丸

正确答案：B。青娥丸

解析：青蛾丸功能补肾强腰，无明显的寒热偏向，最合适治疗腰痛无明显阴阳偏盛。（B对）。杜仲丸功能补肾滋阴，益气养血，用于治疗虚劳腰痛，日久不愈，阴阳俱虚，阴虚内热者（A错）。补髓丹功能补髓生精，用于治疗房劳过度而致肾虚腰痛者（C错）。虎潜丸功能补益肝肾，滋阴清热，为治疗痿证肝肾亏损证的选方（D错）。补血荣筋丸功能滋阴补血，强筋健骨，用于治疗痿证（E错）。